头痛患者，疼痛日久，其痛如锥刺，固定不移,舌质紫，脉细涩。其证候是
A. 肝郁
B. 痰浊
C. 血虚
D. 肾虚
E. 瘀血

正确答案：E。瘀血

解析：久病入络，或头部外伤，瘀血内停，脉络不畅，故疼痛日久，固定不移,其痛如锥刺；舌质紫，脉细涩为瘀血内阻之征。故诊断为头痛瘀血头痛（E对）。肝郁可致肝脉阻滞而见腹痛、胁痛等症（A错）。痰浊头痛以头痛昏蒙，胸脘满闷，纳呆呕恶等症为特点，可见舌苔白腻，脉滑或弦滑（B错）。血虚头痛以头痛隐隐，时时昏晕，心悸失眠，面色少华，神疲乏力，遇劳加重等症为特点，可见舌质淡，苔薄白脉细弱（C错）。肾虚头痛以头痛且空，眩晕耳鸣，腰膝酸软，神疲乏力，滑精带下等症为特点，可见舌红少苔，脉细无力（D错）。